学校卫生工作的主要任务不包括下面哪一点
A. 监测学生健康状况
B. 对学生进行健康，培养学生良好的卫生习惯
C. 改善学校卫生环境和教学卫生条件
D. 加强对传染病，学生常见病的预防和治疗
E. 加强对教师的卫生知识培训和健康体检工作

正确答案：E。加强对教师的卫生知识培训和健康体检工作